引起脚气病的原因是
A. 维生素B₁缺乏
B. 维生素B₂缺乏
C. 维生素C缺乏
D. 维生素D缺乏
E. 维生素K缺乏

正确答案：A。维生素B₁缺乏

解析：维生素B₁的需要量正常成人每日为1.0～1.5mg，缺乏时可引起脚气病和末梢神经炎。掌握“水溶性维生素”知识点。